下列哪种农药的毒作用机制是抑制乙酰胆碱酯酶的活性
A. 溴氰菊酯
B. 西维因
C. 滴滴涕
D. 敌蚜胺

正确答案：B。西维因

解析：本题考查氨基甲酸酯的机制。氨基甲酸酯类农药的急性毒作用机制是直接抑制体内的乙酰胆碱酯酶。即以整个分子与酶形成疏松复合物。氨基甲酸酯与乙酰胆碱酯酶的结合是可逆的，疏松的复合物既可解离，释放出游离的胆碱酯酶，也可进一步形成一个稳定的氨基甲酰化胆碱酯酶和一个脱离基团。氨基甲酸酯中最常用的是西维因（B对ACD错）。